某女，40岁。感冒6日，症见头身疼痛、恶寒无汗、鼻塞流涕、咳嗽。治当解表散寒、祛风胜湿，宜选用的成药是
A. 荆防颗粒
B. 感冒清热颗粒
C. 九味羌活颗粒
D. 双黄连颗粒
E. 连花清瘟胶囊

正确答案：A。荆防颗粒

解析：本题考查的是荆防颗粒的功能。治当解表散寒、祛风胜湿，宜选用的成药是荆防颗粒（A对）。荆防颗粒【功能】解表散寒，祛风胜湿。感冒清热颗粒（B错）【功能】疏风散寒，解表清热。九味羌活丸（C错）【功能】疏风解表，散寒除湿。双黄连合剂（D错）【功能】疏风解表，清热解毒。连花清瘟胶囊（E错）【功能】清瘟解毒，宣肺泄热。